低张性缺氧时可有：
A. 氧饱和度正常
B. 动静脉氧差增大
C. 血氧容量明显降低
D. 血氧含量减少
E. 以上都不对

正确答案：D。血氧含量减少

解析：以动脉血氧分压降低、血氧含量减少为基本特征的缺氧称为低张性缺氧，又称乏氧性缺氧。动脉血氧含量减少（D对）、血氧容量正常或增高（C错）、氧饱和度降低（A错）和动-静脉血氧含量差正常或降低（B错）是低张性缺氧的血氧变化特点。